最适宜作桥体龈面的材料是
A. 金合金
B. 镍铬合金
C. 热凝树脂
D. 复合树脂
E. 烤瓷

正确答案：E。烤瓷

解析：桥体龈端都应高度抛光。粗糙的龈端使菌斑容易附着，导致黏膜炎症。在各类材料制作的桥体中烤瓷桥体表面上釉后最为光滑，对黏膜无刺激性。掌握“固定桥的设计”知识点。